养生中，体质偏阳者
A. 食宜凉
B. 食宜温
C. 食宜清淡
D. 食宜酸
E. 食宜甘

正确答案：A。食宜凉

解析：在食养方面，体质偏阳者，进食宜凉而忌热（A对）；体质偏寒者，进食宜温而忌寒（B错）；阴虚之体，饮食宜甘润生津，忌肥甘厚味、辛辣燥烈之品（E错）；阳虚之体宜温补，忌生冷寒凉之品等。